使血糖含量降低的激素是
A. 甲状腺激素
B. 胰高血糖素
C. 肾上腺素
D. 糖皮质激素
E. 胰岛素

正确答案：E。胰岛素